不会引起肺部病变的有机粉尘有
A. 面粉
B. 棉尘
C. 污染真菌的枯草
D. 污染真菌的蔗渣
E. 聚氯乙烯尘

正确答案：A。面粉